在体内可被代谢产生2-苯基丙烯醛，易与蛋白的亲核基团发生迈克尔加成，产生特质性毒性的药物是
A. 沙丁胺醇
B. 肾上腺素
C. 非尔氨酯
D. 吲哚美辛
E. 醋磺己脲

正确答案：C。非尔氨酯

解析：本题考查非尔氨酯。在体内可被代谢产生2-苯基丙烯醛，易与蛋白的亲核基团发生迈克尔加成，产生特质性毒性的药物是非尔氨酯（C对）。非尔氨酯能提高惊厥阈、镇静作用小，临床上作为癫痫治疗的加用药。支气管扩张药沙丁胺醇（A错）结构中的酚羟基与硫酸形成硫酸酯化结合物。肾上腺素（B错）经儿茶酚-O-甲基转移酶（COMT）快速甲基化后生成3-O-甲基肾上腺素。吲哚美辛（D错）在体内约有50%经O-脱甲基代谢，生成无活性的化合物。口服降糖药醋磺己脲（E错）发生脂环的氧化反应，主要代谢产物是反式4-羟基醋磺己脲。